某女，45岁。带下量多，绵绵不断，质清稀如水，腰痛如折，畏寒肢冷，小腹冷感，面色晦暗，小便清长，夜尿频多，大便溏薄，舌淡苔白润，脉沉迟。宜选用的治法是
A. 健脾益气，除湿止带
B. 温肾培元，固涩止带
C. 疏肝健脾，利湿止带
D. 健脾固肾，除湿止带
E. 清热解毒，利湿止带

正确答案：B。温肾培元，固涩止带

解析：本题考查的是带下过多的辨证论治。带下量多，绵绵不断，质清稀如水，腰痛如折，畏寒肢冷，小腹冷感，面色晦暗，小便清长，夜尿频多，大便溏薄，舌淡苔白润，脉沉迟。宜选用的治法是温肾培元，固涩止带（B对）。带下过多是指带下量明显增多，色、质、气味异常，或伴有局部及全身症状者。西医学各类型阴道炎、急慢性子宫颈炎、盆腔炎性疾病、内分泌功能失调等疾病以阴道分泌物增多为主要表现时，可参考此内容辨证论治。（一）脾虚湿盛证：【症状】带下量多，色白或淡黄，质稀薄，或如涕如唾，绵绵不断，无臭；面色㿠白或萎黄，四肢倦怠，脘胁不舒，纳少便溏，或四肢浮肿。舌淡胖，苔白或腻，脉细缓。【治法】健脾益气，升阳除湿（A错）。（二）肾阳亏虚证：【症状】带下量多，绵绵不断，质清稀如水；腰痛如折，畏寒肢冷，小腹冷感，面色晦暗，小便清长，或夜尿多，大便溏薄。舌质淡，苔白润，脉沉迟。【治法】温肾培元，固涩止带。（三）湿热下注证：【症状】带下量多，色黄或呈脓性，质黏，有臭气，或带下色白质黏，呈豆渣样，外阴瘙痒，小腹作痛，口苦口腻，胸闷纳呆，小便短赤。舌红，苔黄腻，脉滑数。【治法】清热利湿，解毒杀虫（E错）。治法为疏肝健脾，利湿止带（C错）或健脾固肾，除湿止带（D错）的病证，2022年考试指南未明确说明。